双胎输血综合征多见于
A. 双绒毛膜双羊膜囊双胎
B. 单绒毛膜双羊膜囊双胎
C. 双绒毛膜单羊膜囊双胎
D. 单绒毛膜单羊膜囊双胎
E. 联体双胎

正确答案：B。单绒毛膜双羊膜囊双胎

解析：双胎输血综合征多见于单绒毛膜双羊膜囊双胎（B对），通过胎盘间的动－静脉吻合支，血液从动脉向静脉单向分流，使一个胎儿成为供血儿，另一个胎儿成为受血儿，造成供血儿贫血、血容量减少，致使肾灌注不足、羊水过少，甚至因营养不良而死亡；受血儿血容量增多，可发生充血性心力衰竭、胎儿水肿、羊水过多。